受理执业医师注册申请的卫生行政部门，对应当准予注册的，准予注册期限是自收到申请之日起
A. 7日内
B. 10日内
C. 15日内
D. 30日内
E. 60日内

正确答案：D。30日内